以下肿瘤（或囊肿）生长方式特殊，主要沿颌骨前后方向生长的是
A. 成釉细胞瘤
B. 牙源性角化囊性瘤
C. 牙源性钙化上皮瘤
D. 成釉细胞纤维瘤
E. 含牙囊肿

正确答案：B。牙源性角化囊性瘤

解析：牙源性角化囊肿的生长方式特殊，主要沿颌骨前后方向生长，多数患者无明显症状，多在常规X线检查时偶然发现。掌握“牙源性角化囊性瘤”知识点。